土壤轻度污染起始值表示
A. 土壤中污染物浓度超过评价标准数值
B. 作物中污染物浓度超过其背景值
C. 作物中污染物浓度达到食品卫生标准
D. 土壤中污染物浓度超过空气质量标准
E. 作物中污染物浓度超过每日容许摄入量

正确答案：B。作物中污染物浓度超过其背景值

解析：本题考查土壤轻度污染起始值表示的内容。根据土壤污染程度不同将指数分成：1.土壤显著受污染起始值，表示土壤中污染物浓度超过评价标准数值（A错）；2.土壤轻度污染起始值：表示作物中污染物浓度超过其背景值（B对DE错）；3.土壤重度污染起始值：表示作物中污染物浓度达到食品卫生标准（C错）。